为了预防工作有关疾病应该
A. 加强个人防护
B. 开展心理卫生教育
C. 改善作业环境
D. 加强个人卫生习惯教育
E. 采取正确的作业方式

正确答案：E。采取正确的作业方式